主要化学成分为胆汁酸类化合物的药材是
A. 牛黄
B. 牛膝
C. 知母
D. 柴胡
E. 罗布麻叶

正确答案：A。牛黄

解析：本题考查的是牛黄的化学成分。主要化学成分为胆汁酸类化合物的药材是牛黄（A对）。牛黄约含8%胆汁酸，主要成分为胆酸、去氧胆酸和石胆酸。牛膝（B错）含有甾体化合物，包括蜕皮激素和植物甾醇等，蜕皮激素主要为羟基促蜕皮甾酮和牛膝甾酮。知母（C错）中的化学成分主要为甾体皂苷和芒果苷，还含有木脂素、甾醇、鞣质、胆碱等成分。柴胡中含有的总皂苷为1.6%～3.8%。柴胡（D错）中所含皂苷均为三萜皂苷，柴胡皂苷是柴胡的主要有效成分。罗布麻叶（E错）中所含的强心苷主要是甲型强心苷。